确定食物中毒的可疑食物主要是根据
A. 在同一场所同一时间内进食的食物
B. 潜伏期最短者
C. 病人的潜伏期特有的中毒症状
D. 病人的潜伏期呕吐物和排泄物
E. 发病者的临床症状

正确答案：A。在同一场所同一时间内进食的食物

解析：食物中毒是指食用了被有毒有害物质污染的食品或者食用了含有毒有害物质的食品后出现的急性、亚急性疾病 ，其发病与特定食物有关，即近期内都有食用同样的有毒有害食物史，发病范围局限在食用该食物的人群中。若发病者是在同一场所同一时间内进食的食物（A对），可据此推断是食用了同样的有毒有害物质而发病。而呕吐物和排泄物（D错）可能受其他因素影响。食物中毒发病潜伏期短是其特点之一，其长短不能判断中毒食物（B错）。食物中毒的临床表现的基本相似，不能作为可疑食物的判断根据（CE错）。